融合牙是
A. 乳牙列融合牙比恒牙列少
B. 目前无遗传倾向
C. 乳牙融合多双侧发生
D. 乳牙多见于上颌乳中切牙
E. 两个正常牙胚的牙釉质融合在一起而成的

正确答案：E。两个正常牙胚的牙釉质融合在一起而成的

解析：融合牙是由两个正常牙胚的牙釉质或牙本质融合在一起而成的。除牙齿发育受压力因素外，还有遗传倾向。乳牙列融合牙比恒牙列多。乳牙多见于下颌乳中切牙和乳侧切牙，或乳侧切牙和乳尖牙融合。恒牙多见于额外牙和正常牙融合。乳牙融合多单侧发生，两个牙融合多见。乳牙融合常并发继承恒牙先天缺失现象。掌握“迟萌、多生牙和融合牙”知识点。